能主动吸收钠、排出钾的是
A. 闰管
B. 分泌管
C. 小叶间导管
D. 排泄管
E. 以上都不是

正确答案：B。分泌管

解析：分泌管与闰管相延续。管径较粗，管壁由单层柱状上皮所组成。在基底部有垂直于基底面的纵纹，所以分泌管又称纹管。上皮细胞能主动吸收钠，排出钾和碳酸氢根离子，并转运水，改变唾液的量和渗透压。掌握“唾液腺组织结构”知识点。